嗜酸性腺瘤肉眼观察，其说法错误的是
A. 肿瘤为光滑的圆形或卵圆形
B. 一般直径为3～5cm
C. 包膜完整，界限清楚
D. 淡黄色或褐色的实性剖面
E. 肿瘤实质是由无数小囊腔组成

正确答案：E。肿瘤实质是由无数小囊腔组成

解析：嗜酸性腺瘤肉眼观察，肿瘤为圆形或卵圆形，表面光滑，有时呈结节状，一般直径为3～5cm，包膜完整，界限清楚。剖面实性，淡黄色或褐色，分叶状，偶见小囊腔。掌握“沃辛瘤及嗜酸性腺瘤”知识点。